卵巢位置
A. 位于卵巢窝内
B. 位于髂内、外动脉夹角内
C. 位于子宫阔韧带后层内
D. 胎儿时位于腹后壁
E. 上述全对

正确答案：E。上述全对

解析：卵巢位置可描述为位于卵巢窝内（A对），髂内、外动脉夹角内（B对），子宫阔韧带的后层内（C对）或卵巢在胎儿时位于腹后壁（D对，E为本题正确答案）。